患者，男，40岁。患风湿性心脏瓣膜病多年。症见心悸气短，神疲乏力，咳嗽喘促，颧颊暗红，唇甲青紫，舌有瘀斑，脉细结代。其治法是
A. 温补心阳
B. 滋阴安神
C. 温阳利水
D. 泻肺利水
E. 益气活血

正确答案：E。益气活血

解析：心主血脉，心脉瘀阻，心失所养故见心悸气短，神疲乏力，咳嗽喘促；脉络瘀阻故见颧颊暗红，唇甲青紫；舌有瘀斑，脉细结代均为气虚血瘀之侯。说明该患者心气虚无力推动血液运行而导致心血瘀阻的症状，治法应益气活血（E对）。温补心阳（A错）治疗心肾阳虚证。滋阴安神（B错）治疗阴虚神志不安证。温阳利水（C错）治疗阳虚水泛证。泻肺利水（D错）治疗水饮阻肺证。